治疗昏迷，高热，应首选
A. 四缝
B. 曲池
C. 八邪
D. 合谷
E. 十宣

正确答案：E。十宣

解析：该题考查奇穴的主治。四缝主治：①小儿疳积②百日咳（A错）。曲池主治：①手臂痹痛、上肢不遂等上肢病证②热病③高血压④癫狂⑤腹痛、吐泻等肠胃病证⑥咽喉肿痛、齿痛、目赤肿痛等五官热性病证⑦瘾疹、湿疹、瘰疬等皮肤、外科疾患（B错）。八邪主治：①手背肿痛，手指麻木②烦热，目痛③毒蛇咬伤（C错）。合谷主治：①头痛、目赤肿痛、齿痛、鼻衄、口眼歪斜、耳聋等头面五官诸疾②发热恶寒等外感病证，热病无汗或多汗③经闭、滞产等妇产科病证（D错）。十宣【主治】①昏迷；②癫痫；③高热，咽喉肿痛；④手指麻木（E对）。